与甲状腺髓样癌有关的激素是
A. 甲状腺素
B. 促甲状腺素
C. 降钙素
D. 促甲状腺激素释放激素
E. 胰高血糖素

正确答案：C。降钙素

解析：甲状腺髓样癌又称C细胞癌，是来源于甲状腺滤泡旁细胞的恶性肿瘤，属于APUD瘤（神经内分泌肿瘤），90%的肿瘤分泌降钙素，可引起严重的腹泻及低钙血症。因此，与甲状腺髓样癌有关的激素是降钙素（C对）。甲状腺激素分泌水平依托下丘脑-腺垂体-甲状腺轴，形成促甲状腺激素释放激素（D错）-促甲状腺素（B错）-甲状腺素（A错）自动控制环路，此三种激素主要与甲状腺功能亢进及甲状腺功能减退相关，与甲状腺髓样癌无关。胰高血糖素（E错）主要与胰高血糖素瘤有关。